桃仁可用于
A. 肺热咳嗽
B. 肠燥便秘
C. 痰气闭塞心窍之癫痫
D. 斑疹色暗
E. 风寒头痛

正确答案：B。肠燥便秘

解析：本题考查的是桃仁的主治病证。桃仁可用于肠燥便秘（B对）。桃仁：【主治病证】（1）血滞闭经、痛经，产后腹痛，癥瘕，跌打肿痛。（2）肺痈，肠痈。（3）肠燥便秘。（4）咳喘。虎杖：【主治病证】（1）湿热黄疸，淋浊，带下。（2）水火烫伤，疮痈肿毒，毒蛇咬伤。（3）闭经，痛经，癥瘕，跌打损伤，风湿痹痛。（4）肺热咳嗽（A错）。（5）热结便秘。（6）肝胆及泌尿系结石症。郁金：【性能特点】本品辛行散，苦泄降，寒清凉，入心、肝、胆、肺经。走血走气，既活血止痛，又疏肝行气解郁，还清心凉血而止血、醒神、利胆退黄，为活血行气凉血之要药。凡血瘀气滞有热、肝郁化火、血热出血、热扰心神及湿热郁闭心窍，皆可酌选（C错）。【主治病证】（1）胸腹胁肋胀痛或刺痛，月经不调，痛经，癥瘕痞块。（2）热病神昏，癫痫发狂。（3）血热之吐血、衄血、尿血，妇女倒经。（4）湿热黄疸，肝胆或泌尿系结石症。红花：【主治病证】（1）血滞闭经、痛经，产后恶露不尽。（2）胸痹心痛，癥瘕积聚，跌打肿痛。（3）斑疹色暗（D错）（配清热凉血解毒药）。川芎：【主治病证】（1）月经不调，痛经，闭经，难产，产后瘀阻腹痛。（2）胸痹心痛，胁肋作痛，肢体麻木，跌打损伤，疮痈肿痛。（3）头痛（E错），风湿痹痛。